胫骨易发生骨折的部位是
A. 上端干骺端部位
B. 横切面三棱形部位
C. 横切面四边形部位
D. 横切面三棱与四边形移行部位
E. 踝上部位

正确答案：D。横切面三棱与四边形移行部位

解析：胫骨是承重的重要骨骼之一，胫骨干中、上1/3横切面呈三棱形，下1/3横切面呈四边形，在三棱形和四边形移行处是骨折的好发部位（D对）。